用于制备中药注射剂的半成品有效成分的纯度应达到
A. 0.25
B. 0.5
C. 0.7
D. 0.85
E. 90%以上

正确答案：E。90%以上